石菖蒲的功效是
A. 开窍，止痛
B. 开窍，活血
C. 开窍，化湿
D. 开窍，清热
E. 开窍，行气

正确答案：C。开窍，化湿

解析：本题考查石菖蒲的功效。石菖蒲的功效是开窍，化湿（C对）。石菖蒲【功效】开窍宁神，化湿和胃。安息香【功效】开窍辟秽，行气（E错）活血（B错），止痛（A错）。冰片【功效】开窍醒神，清热（D错）止痛。